预防甲状腺功能减退症粘液性水肿昏迷的关键是
A. 坚持甲状腺素替代治疗
B. 水摄入量不宜过多
C. 禁用镇静安眠药
D. 增强免疫力
E. 避免过度劳累

正确答案：A。坚持甲状腺素替代治疗

解析：甲状腺功能减退症粘液性水肿昏迷发生的原因为血甲状腺激素减少，因此预防的关键是坚持甲状腺素替代治疗（A对），通常需终生服药。水摄入量不宜过多（B错）、禁用镇静安眠药（C错）、增强免疫力（D错）、避免过度劳累（E错）为一般预防治疗，未从根本上预防粘液水肿性昏迷的发生。